关于掌跖角化-牙周破坏综合征病因描述正确的是
A. 属于常染色体显性遗传
B. 男患病几率更高
C. 组织蛋白酶C（CTSC）基因的突变
D. 中性粒细胞趋化功能升高
E. 以上均正确

正确答案：C。组织蛋白酶C（CTSC）基因的突变

解析：本题考查掌跖角化-牙周破坏综合征。关于掌跖角化-牙周破坏综合征病因描述正确的是组织蛋白酶C（CTSC）基因的突变（C对）。掌跖角化-牙周破坏综合征为遗传性疾病，属于常染色体隐性遗传（A错）。父母不患该症，但可能为血缘婚姻（约占23％），双亲必须均携带常染色体基因才使其子女患本病。患者的同胞也可患本病，男女患病概率均等（B错）。国内外均有学者报告本病患者的中性粒细胞趋化功能降低（D错）。有研究报告本病与角质素基因的突变有关。最近的研究显示，组织蛋白酶C（CTSC）基因的突变可能是掌跖角化-牙周破坏综合征（PIS）的致病基础。组织蛋白酶C是一种含半胱氨酸蛋白酶，它的主要功能是降解蛋白和活化一些酶原物质，比如它对于来源于骨髓和淋巴系统的一些细胞中的丝氨酸蛋白酶的活化有着重要的作用，而这种蛋白酶包含在很多免疫和炎症反应过程中，包括细菌的吞噬破坏、局部细胞因子和其他炎症介质的活化和去活化。